患者出现渴不多饮，除下列哪项外均可导致
A. 寒湿
B. 湿热
C. 阴虚
D. 痰饮
E. 瘀血

正确答案：A。寒湿

解析：口不渴，患者无明显口渴的感觉，饮水也不多。因寒、湿为阴邪，不耗伤津液，所以口不渴（A错，为本题正确答案）。湿热证表现为口渴不多饮，兼身热不扬，头身困重，胸闷纳呆，舌苔黄腻（B对）。阴虚证，因阴津亏虚，虚火内扰，故见口干不欲饮，兼见五心烦热，颧红盗汗，舌红少苔，脉细数（C对）。痰饮病，表现为口渴喜热饮，饮入不多，或水入即吐（D对）。血瘀证表现为口干，但欲漱水不欲咽，兼舌质青紫、脉涩（E对）。